下列清热解毒药中，兼有止血功效的是
A. 穿心莲
B. 秦皮
C. 白鲜皮
D. 熊胆
E. 马齿苋

正确答案：E。马齿苋

解析：穿心莲具有清热解毒，凉血，消肿，燥湿的功效，无止血之功（A错）。秦皮为清热燥湿药（B错）。白鲜皮为清热燥湿药（C错）。熊胆具有清热解毒，息风止痉，清肝明目的功效，无止血之功（D错）。马齿苋具有清热解毒，凉血止血，止痢的功效（E对）。